白茅根除利尿通淋外，又能
A. 化瘀止血
B. 凉血止血
C. 温经止血
D. 收敛止血
E. 益气摄血

正确答案：B。凉血止血

解析：本题考查的是白茅根的功效。白茅根除利尿通淋外，又能凉血止血（B对）。白茅根：【功效】凉血止血，清热生津，利尿通淋。三七：【功效】化瘀止血（A错），活血定痛。艾叶：【功效】温经止血（C错），散寒止痛。白及：【功效】收敛止血（D错），消肿生肌。功效为益气摄血（E错）的中药，2022年考试指南未明确说明。